下列哪个不是社区卫生服务的重点人群
A. 妇女、儿童
B. 老年人
C. 残疾人
D. 慢性病患者
E. 中青年

正确答案：E。中青年